“加强随访和管理，使其知道坚持从医行为、遵从医嘱服药和非药物治疗的重要性”，这一高血压病的社区健康促进对策，适用于
A. 高血压病患者及其家属
B. 社区一般人群
C. 高危人群
D. 社会公众
E. 社区领导

正确答案：A。高血压病患者及其家属